男，46岁。“慢性肝炎“病史10余年。20小时前进食烙饼后呕血约200ml，排黑便约100ml，2小时来意识障碍，不识家人。治疗中错误的是
A. 静脉点滴支链氨基酸
B. 肥皂水灌肠清除积血
C. 硫酸镁导泻
D. 静脉输入止血芳酸
E. 限制蛋白饮食

正确答案：B。肥皂水灌肠清除积血

解析：中年男性患者，慢性肝炎病史10余年（肝硬化的高危人群，肝硬化为肝性脑病最常见的病因），20小时前进食烙饼（上消化道出血的常见诱因为进食粗糙食物）后呕血200ml，排黑便约100ml（上消化道出血的表现，肝性脑病的诱因），2小时来意识障碍、不识家人（肝性脑病高级神经中枢功能紊乱的表现），综合患者的病史、临床表现，可初步诊断为肝硬化上消化道出血后肝性脑病。氨中毒为肝性脑病最主要的发病机制，消化道是氨产生的主要部位。肝性脑病治疗时应尽早采取措施去除诱因，如硫酸镁导泻（C对）可清除肠道内积血、静脉输入止血芳酸（D对）可以止血、限制蛋白饮食（E对）均可以减少氨的产生。肥皂水（B错，为本题正确答案）多数为碱性溶液，可增加肠道氨的吸收，加重病情。神经递质变化假说为肝性脑病发病的另一发病机制。静脉点滴支链氨基酸（A对）可竞争性抑制芳香族氨基酸进入大脑，减少假性神经递质的形成，缓解病情。